一中年男性，体胖，有高血压、高脂血症病史，近来有心前区疼痛出现。心肌梗死最常见的冠状动脉闭塞是
A. 左冠状动脉回旋支
B. 右冠状动脉
C. 左冠状动脉主干
D. 右冠状动脉加左冠状动脉回旋支
E. 左冠状动脉前降支

正确答案：E。左冠状动脉前降支